切面内皮层环纹明显的饮片有
A. 土茯苓
B. 百部
C. 莪术
D. 姜黄
E. 白及

正确答案：C、D。莪术；姜黄

解析：本题考查的是莪术和姜黄的性状鉴别。切面内皮层环纹明显的饮片有莪术（C对）、姜黄（D对）。莪术【性状鉴别】饮片莪术：呈类圆形或椭圆形厚片。外表皮灰黄色或灰棕色，有时可见环节或须根痕，切面黄绿色、黄棕色或棕褐色，内皮层环纹明显，散在“筋脉”小点。气微香，味微苦而辛。姜黄【性状鉴别】饮片呈类圆形或不规则形厚片。外表皮深黄色，有时可见环节，切面棕黄色或金黄色，角质样，内皮层环纹明显，维管束点状散在。土茯苓（A错）【性状鉴别】饮片呈长圆形或不规则的薄片，边缘不整齐。切面黄白色或红棕色，粉性，可见点状维管束及多数小亮点；以水湿润后有黏滑感。气微，味微甘、涩。百部（B错）【性状鉴别】饮片百部：呈不规则厚片或不规则的条形斜片。表面灰白色、棕黄色，有深纵皱纹。切面灰白色、淡黄棕色或黄白色，角质样；皮部较厚，中柱扁缩。质韧软。气微，味甘、苦。白及（E错）【性状鉴别】饮片呈不规则的薄片。外表皮灰白色至灰棕色，或黄白色。切面类白色至黄白色，角质样，半透明，维管束小点状，散生。质脆。气微，味苦，嚼之有黏性。